人体有机整体的中心是
A. 心
B. 脑
C. 五脏
D. 六腑
E. 经络

正确答案：C。五脏

解析：人体以五脏为中心，配合六腑、形体、官窍，通过经络系统的联络作用，构成了心、肝、脾、肺、肾五个生理系统。心、肝、脾、肾五个生理系统之间，具有结构的联系性和功能的系统性，相互促进，相互制约，共同维持生命活动的正常进行（C对）。